胃左动脉与肝总动脉之间的联系主要通过
A. 胃右动脉
B. 胃十二指肠动脉
C. 胃短动脉
D. 右结肠动脉
E. 左结肠动脉

正确答案：A。胃右动脉

解析：胃右动脉（A对）为胃左动脉与肝总动脉之间的主要联系。肝总动脉发出分支干固有动脉，继之发出胃右动脉与胃左动脉相吻合。